维持阴道微生平衡最重要的菌群是
A. 乳杆菌
B. 厌氧菌
C. 加德纳菌
D. 肠球菌
E. 念珠菌

正确答案：A。乳杆菌

解析：生理情况下，雌激素使阴道上皮增生变厚并增加细胞内糖原含量，阴道上皮细胞分解糖原为单糖，阴道乳杆菌将单糖转化为乳酸，维持阴道正常的酸性环境（PH≤4.5，多在3.8～4.4），抑制其他病原体生长，称为阴道自净作用。正常阴道微生物群中，以产生过氧化氢的乳杆菌为优势菌，乳杆菌除维持阴道的酸性环境外，其产生的H₂O₂、细菌素等抗微生物因子可抑制致病微生物生长，同时通过竞争排斥机制阻止致病微生物黏附于阴道上皮细胞，维持阴道微生态平衡（A对）。加德纳菌是革兰阴性需氧菌及兼性厌氧菌，肠球菌是革兰阳性需氧菌及兼性厌氧菌，念珠菌是真菌，均为阴道正常微生物群。